根据充分病因-组分病因模型，在不知道病原体是什么的情况下，仍然可以有效地控制传染病，是因为
A. 病原体不是传染病的必要病因
B. 病原体是传染病的非必要非充分病因
C. 可以阻断那些不包括病原体这个组分病因的充分病因
D. 可以阻断除病原体以外的其他组分病因，从而使传染病的许多充分病因不能成立
E. 某传染病的发病并非100%可以归因于相关的病原体

正确答案：D。可以阻断除病原体以外的其他组分病因，从而使传染病的许多充分病因不能成立

解析：本题考查充分病因和组分病因。根据充分病因-组分病因模型，在不知道病原体是什么的情况下，仍然可以有效地控制传染病，是因为可以阻断除病原体以外的其他组分病因，从而使传染病的许多充分病因不能成立（D对ABCE错）。